7月初，6岁小儿突发高热，抽搐，昏迷，脑膜刺激征（±），初步诊为乙脑，首先要和哪种疾病鉴别
A. 中毒性菌痢
B. 流行性脑脊髓膜炎
C. 散发性脑炎
D. 感染中毒性脑病
E. 结核性脑膜炎

正确答案：A。中毒性菌痢